参与辅酶A组成的维生素是
A. 维生素B₁
B. 维生素B₆
C. 维生素PP
D. 叶酸
E. 泛酸

正确答案：E。泛酸